患者，女，19岁。患肾病综合征，症见眼睑浮肿，时有四肢、全身浮肿，身发痈疡，恶风发热，小便不利，舌红，苔薄黄，脉滑数。其证型是
A. 湿毒浸淫
B. 风水相搏
C. 水湿浸渍
D. 湿热内蕴
E. 脾虚湿困

正确答案：A。湿毒浸淫

解析：肌肤乃脾肺所主之域，湿毒伤脾肺，肺失通调，脾失运输，水湿内停，故见眼睑浮肿，时有四肢、全身浮肿，恶风发热，小便不利；湿毒浸淫故见身发痈疡；舌红，苔薄黄，脉滑数均为湿毒浸淫证的表现（A对）。风水相搏证（B错）的特点为起始眼睑浮肿，继则四肢、全身亦肿，皮肤光泽，按之凹陷易回复，伴发热，咽痛，咳嗽，小便不利等证，舌苔薄白，脉浮。水湿浸渍证（C错）的特点为全身水肿，按之没指，伴有胸闷腹胀，身重困倦，纳呆，泛恶，小便短少。湿热内蕴证（D错）的特点为浮肿明显，肌肤绷急，腹大胀满，胸闷烦热，口苦咽干，大便干结，小便短赤。脾虚湿困证（E错）的特点为浮肿，按之凹陷不易恢复，腹胀纳少，面色萎黄，神疲乏力，尿少色清，大便或溏。